主要用于治疗人表皮生长因素受体-2过度表达的转移性乳腺癌的首选单克隆抗体药物是
A. 他莫昔芬
B. 曲妥珠单抗
C. 戈舍瑞林
D. 贝伐珠单抗
E. 阿达木单抗

正确答案：B。曲妥珠单抗

解析：本题考查乳腺癌治疗药物。曲妥珠单抗（B对）主要用于人表皮生长因子受体-2过度表达的转移性乳腺癌，以及已接受过1个或多个化疗方案的转移性乳腺癌、联合紫杉烷类药治疗未接受过化疗的转移性乳腺癌。